男性，35岁。双下肢水肿2周。查体：血压130/80mmHg，双下肢轻度凹陷性水肿。尿常规：蛋白++++，红细胞++。Scr122μmol/L。血浆白蛋白28g/L。为明确诊断，不需要的检查项目是
A. 肾活检
B. 双肾超声
C. 肾CT
D. 尿蛋白定量
E. 血脂

正确答案：C。肾CT

解析：中年男性患者，双下肢凹陷性水肿，血压正常，蛋白++++（提示大量蛋白尿），血浆白蛋白28g/L（正常值≥30g/L）。患者存在大量蛋白尿、低蛋白血症级水肿，符合肾病综合征的诊断标准，考虑患者诊断为肾病综合症。为明确诊断，应首先做肾活检（A对），肾活检对明确各种肾脏疾病的诊断及鉴别诊断均具有重要价值。肾病综合症患者需行尿蛋白定量检查（D对），大于3.5g/d符合诊断标准。肾病综合症常有高脂血症，故需行血脂（E对）测定。肾病综合征患者早期肾脏多轻度增大，可双肾超声（B对）观察双肾情况。肾脏CT对于肾脏的诊断效果与B超类似，且其有放射性及价格贵的缺点，故该患者肾CT（C错，为本题正确答案）。